病例对照研究中，比值比（OR）的含义是
A. 病例组的发病率与对照组的发病率之比
B. 病例组的发病率与对照组的发病率之差
C. 病例组的暴露比值与对照组的暴露比值之比
D. 对照组的暴露比值与病例组的暴露比值之比
E. 病例组的暴露比值与对照组的暴露比值之差

正确答案：C。病例组的暴露比值与对照组的暴露比值之比

解析：本题考查比值比的含义。比值比为病例组与对照组两组暴露比值之比（C对ABDE错），表示暴露者疾病的危险性是不暴露者的多少倍。